根据骨度分寸法，脐中至耻骨联合上缘是
A. 5寸
B. 7寸
C. 8寸
D. 9寸
E. 12寸

正确答案：A。5寸

解析：骨度分寸中：相距5寸的标志有：脐中至耻骨联合上缘（A对）； 8寸（C错）的有：歧骨至脐中、两乳头连线；9寸（D错）的有：前额两发角之间、天突至胸剑联合、耳后两乳突之间、腋前纹头至肘横纹；12寸（E错）的有：前后发际之间、肘横纹至腕横纹。